与来访者找到较多的"共同语言"是
A. 要有一颗帮助别人的心
B. 要有一个敏锐的观察力
C. 要遵守职业道德
D. 每天要具备好的心情
E. 要有丰富的生活经验和知识

正确答案：E。要有丰富的生活经验和知识

解析：一个资深的心理治疗师要有丰富的生活经验和知识，应了解社会各层各界人士的生活与工作。要有较宽的知识面，应该不仅懂得医学、心理学还应懂得社会学、人类学等，才有可能与来访者找到较多的"共同语言"。掌握“心理治疗原则、主要方法及应用”知识点。